癫痫持续状态首选的治疗药物是
A. 苯妥英钠
B. 地西泮
C. 水合氯醛
D. 异戊巴比妥
E. 苯巴比妥钠

正确答案：B。地西泮

解析：地西泮（B对）属于苯二氮卓类药物，具有抗焦虑、镇静催眠、抗惊厥、肌肉松弛等作用，其中地西泮静脉注射是目前治疗癫痫持续状态的首选药物。苯妥英钠（A错）是治疗大发作和局限性发作的首选药物。水合氯醛（C错）是催眠药和抗惊厥药，用于失眠烦躁不安和惊厥。异戊巴比妥、苯巴比妥钠（DE错）是镇静催眠药，临床主要用于治疗癫痫大发作及癫痫持续状态，但不作为首选。